未累及患者的用药差错属于
A. A级差错
B. B级差错
C. C级差错
D. D级差错
E. I级差错

正确答案：B。B级差错

解析：本题考查用药差错分级。B级差错（B对）指发生差错但未发给患者，或已发给患者但未使用。A级差错（A错）指客观环境或条件可能引发差错（差错隐患）。C级差错（C错）指患者已使用，但未造成伤害。D级差错（D错）指患者已使用，需要监测差错对患者的后果，并根据后果判断是否需要采取措施预防和减少伤害。I级差错（E错）指差错导致患者死亡。